B细胞分化发育成熟的标志是
A. IgG
B. IgM
C. IgD
D. IgE
E. IgA

正确答案：C。IgD